男，17岁。骑摩托车时不慎摔倒，左颅顶着力，短暂昏迷后清醒。伤后30分钟送医院，急诊头颅CT示左颅顶颅骨骨折。2小时后头痛加剧，逐渐昏迷，左侧瞳孔散大，右侧肢体瘫痪。首先考虑的诊断是
A. 颈椎损伤、颈髓受压
B. 脑挫裂伤、脑干损伤
C. 急性硬脑膜外血肿、小脑幕切迹疝
D. 急性硬脑膜下血肿、脑挫裂伤
E. 急性硬脑膜下血肿、枕骨大孔疝

正确答案：C。急性硬脑膜外血肿、小脑幕切迹疝

解析：青少年男性患者，头部外伤，短暂昏迷后清醒，之后再次陷入昏迷（急性硬膜外血肿的典型表现），左侧瞳孔散大，右侧肢体瘫痪（提示左侧小脑幕切迹疝），急诊头颅CT示左颞顶颅骨骨折（提示可能合并颅内血肿），结合患者病史、临床表现和影像学检查，首先考虑的诊断为左颞顶急性硬膜外血肿合并小脑幕切迹疝（C对）。颈椎损伤、颈髓受压（A错）常表现为受伤平面以下对侧感觉和运动功能障碍，一般无意识障碍、瞳孔改变等表现。脑挫裂伤表现伤后立即发生的意识障碍、头痛、恶心、呕吐等症状，颅内血肿大多合并有脑挫裂伤；脑干损伤表现为伤后立即昏迷并进行性加重，瞳孔大小多变，早期发生呼吸、循环功能衰竭，可出现去皮质强直及双侧病理征阳性等表现（B错）。急性硬脑膜下血肿（DE错）多表现为伤后持续昏迷或昏迷进行性加重，无中间清醒期；枕骨大孔疝表现为剧烈头痛、呕吐，颈项强直，瞳孔可忽大忽小，呼吸、循环等生命体征紊乱出现较早。